苎麻根甘寒，除凉血止血，清热安胎外，又能
A. 活血、杀虫
B. 燥湿、杀虫
C. 活血、利尿
D. 解毒、燥湿
E. 解毒、利尿

正确答案：E。解毒、利尿

解析：本题考查的是苎麻根的功效。苎麻根甘寒，除凉血止血，清热安胎外，又能解毒、利尿（E对）。苎麻根【功效】凉血止血，清热安胎，利尿，解毒。槟榔【功效】杀虫（A错），消积，行气，利水，截症。苦参【功效】清热燥湿，杀虫（B错）止痒，利尿。蒲黄性平，生用、炒用均止血，生用活血化痪止血，并兼利尿（C错），尤善治尿血、血淋。白鲜皮【功效】清热解毒（D错），祛风燥湿，止痒。